关于土壤的叙述，以下哪项是错误的
A. 是人类生活环境的基本因素
B. 土壤的构成和性状能影响微小气候
C. 土壤污染是水源被污染的最主要原因
D. 土壤中的化学成分可以直接影响人体正常的生理功能
E. 土壤承载一定的污染负荷，具有一定的环境容纳量

正确答案：C。土壤污染是水源被污染的最主要原因

解析：本题考查土壤的相关内容。土壤是人类生活环境的基本因素（A对），是人类赖以生存和发展的物质基础。土壤的构成和性状能影响微小气候（B对），如温度、湿度、风速等，这些因素都会影响植物的生长和发育。土壤中的化学成分也可以直接影响人体正常的生理功能（D对），如污染物进入人体后会导致疾病。土壤承载一定的污染负荷，具有一定的环境容纳量（E对），但是当污染物超过容纳量时，就会对土壤环境造成污染，从而影响植物的生长和发育，也会影响人类的健康。土壤污染是水源污染的一个重要原因，但不是最主要原因（C错，为本题正确答案）。